关于牙内吸收的特点不正确的是
A. 多无自觉症状
B. 内吸收发生在根管内时牙冠颜色无变化
C. 牙髓温度测验反应可正常
D. 内吸收发生在髓室时，牙冠颜色无变化
E. X线片显示髓腔内有局限性不规则的膨大透影区域

正确答案：D。内吸收发生在髓室时，牙冠颜色无变化

解析：牙内吸收的临床表现：①多无自觉症状，也可出现自发性、阵发性痛、放散痛和温度刺激痛等牙髓炎症状。②内吸收发生在髓室时，牙冠见有透粉红色区域或暗黑色区。发生在根管内时牙冠颜色无变化。③牙髓温度测验反应可正常，也可表现为敏感或迟钝。④叩诊同正常对照牙或不适。⑤X线片显示髓腔内有局限性不规则的膨大透影区域，严重者可见吸收区穿通髓腔壁，甚至出现牙根折断线。掌握“牙髓坏死、牙髓钙化与牙内吸收”知识点。